在延髓内的神经核是
A. 薄束核
B. 面神经核
C. 三叉神经脑桥核
D. 展神经核
E. 以上都不是

正确答案：A。薄束核

解析：在延髓内的神经核是薄束核（A对），位于延髓薄束结节的深面。面神经核（B错）、三叉神经脑桥核（C错）、展神经核（D错）均位于脑桥。